取模方法根据橡胶印模材料的流动性不同分为
A. 一步法和两步法
B. 解剖法和功能法
C. 直接法和间接法
D. 单次法和多次法
E. 简单法和复杂法

正确答案：A。一步法和两步法

解析：其取模方法主要是根据橡胶印模材料的流动性不同，分为一步法取印模和两步法取印模。掌握“暂时冠及印模与模型”知识点。